主要用于厌氧菌感染的药物是
A. 青霉素
B. 庆大霉素
C. 多西环素
D. 环丙沙星
E. 甲硝唑

正确答案：E。甲硝唑